某1岁男孩，因抽搐入院。上呼吸道感染2天，昨夜发热嗜睡。查体有颈强。体温40℃，WBC17×109/L，腰穿脑脊液细胞数4×109/L，中性粒细胞占88%，诊断为细菌性脑膜炎。细菌培养时发现在预加的金葡菌菌落周围生长旺盛，出现卫星现象。试问所感染的细菌可能是
A. 肺炎克雷伯菌
B. B族链球菌
C. D族链球菌
D. 流感嗜血杆菌
E. 铜绿假单胞菌

正确答案：D。流感嗜血杆菌

解析：流感嗜血杆菌培养时，如果将此菌与金黄色葡萄球菌与血平板上共同培养时，在金黄色葡萄球菌菌落周围的流感嗜血杆菌菌落较大，离金葡菌菌落越远的越小，此现象称为“卫星现象”，有助于流感嗜血杆菌的鉴定。掌握“流感、百日咳及幽门螺杆菌”知识点。